有生命危险的体液pH值上限是
A. 7.6
B. 7.8
C. 7.7
D. 7.9
E. 7.5

正确答案：B。7.8

解析：人体的pH可耐受范围为6.8～7.8。pH7.8是有生命危险的体液pH值上限（B对）。